足三阳经腧穴主治的病证是
A. 胃肠病
B. 咽喉病
C. 头面病
D. 神志病
E. 耳病

正确答案：D。神志病

解析：足阳明经主治前头、口齿、咽喉、胃肠病；足少阳经主治侧头、耳、项、胁肋、胆病；足太阳经主治后头、项、背腰、肛肠病。足少阳经和足太阳经共同主治眼病。足三阳经共同主治神志病、热病（D对）。